健康人的体质应该是
A. 肥胖质
B. 瘦小质
C. 偏阳质
D. 偏阴质
E. 阴阳平和质

正确答案：E。阴阳平和质

解析：在正常生理状态下，机体阴阳总是处于动态的消长变化之中，使体质出现阴阳平和，或偏阴或偏阳的状态。故人体正常体质大致可分为阴阳平和质、偏阳质和偏阴质三种类型。阴阳平和质是功能较为协调的体质类型，趋于人体理想体质，故健康人可为此类型（E对）。偏阳质是具有兴奋、好动、偏热特征的体质类型（C错）。偏阴质是具有抑制、喜静、偏寒特征的体质类型（D错）。